下列符合药物治疗的道德要求是
A. 对症下药合理配伍
B. 联合用药尽量周全
C. 知情同意免担风险
D. 灵活用药观察疗效
E. 少用药物减少费用

正确答案：A。对症下药合理配伍

解析：医务人员进行药物治疗时应遵循的伦理要求包括以下方面：（一）对症下药，因人施治；（二）合理配伍，适时调整（A对）；（三）药以致用，药尽其用；（四）忠于职守，从严管理。医生在应用药物治疗患者时应当以患者为中心，从患者的身体、心理、经济角度衡量处方以求患者利益最大化，而不是为医院牟利。药物的使用应当适度考虑患者个人情况。征求患者意见。由于药物的两重性，医务人员在用药时要发挥其有利的治疗作用，尽量减少和避免不良反应。单种药物能治好的疾病就不联合用药，必须联合用药或使用毒副作用大的药物要根据药理性能合理配伍，以提高抗病能力，克服和对抗一些药物的毒副作用，从而使药物发挥更大的疗效（BCDE错）。